为预防和控制医院感染的发生，应做的工作不包括
A. 加大医院感染的管理力度
B. 妥善处理各种废物
C. 加强医院消毒灭菌的监督和监测
D. 加强临床对抗生索应用的管理
E. 已污染的液体应在严格消毒后再次使用

正确答案：E。已污染的液体应在严格消毒后再次使用